初孕妇，28岁。妊娠36周，血压升高3周，今晨突然腹痛，呈持续性，阵发性加重。BP150/98mmHg，心率112次/分，尿蛋白（++），阴道少量流血。最可能出现的情况是
A. 前置胎盘
B. 子宫肌瘤红色样变
C. 先兆早产
D. 胎盘早剥
E. 先兆子宫破裂

正确答案：D。胎盘早剥

解析：青年初孕妇，妊娠36周（胎盘早剥多发生于20周后），血压升高3周（妊娠期高血压是胎盘早剥发生的高危因素），今晨突然腹痛，呈持续性，阵发性加重，阴道少量流血（胎盘早剥的典型症状为腹痛伴或不伴阴道流血），BP150/98mmHg（1级高血压），心率112次/分（正常值为60～100次/分），尿蛋白（++），该孕妇可考虑为Ⅲ度胎盘早剥（D对）。前置胎盘（P127）（A错）的典型症状为妊娠晚期或临产时，发生无诱因、无痛性反复阴道流血。子宫肌瘤红色样变（P311）（B错）的常见表现为剧烈腹痛伴恶心、呕吐、发热。先兆早产（P48）（C错））指妊娠28周前先出现少量阴道流血，随后出现阵发性下腹痛或腰背痛。先兆子宫破裂（P218）（E错）常见于产程长，有梗阻性难产的孕妇，表现为子宫强直性或痉挛性过强收缩，产妇烦躁不安，呼吸、心率加快，下腹剧痛难忍，出现少量阴道流血。